泻下药的主要功效不包括
A. 泻热
B. 通便
C. 攻下积滞
D. 活血化瘀
E. 逐水退肿

正确答案：D。活血化瘀